女，40岁。向心性肥胖伴乏力3年。查体：BP180/110mmHg，满月脸、多血质，皮肤可见宽大紫纹，血糖12.8mmol/L，血钾3.8mmol/L，尿皮质醇增高，小剂量地塞米松试验不能抑制，但大剂量地塞米松试验能抑制。为明确病因，除肾上腺CT检查外，最需要进行的检查是
A. 鞍区MRI
B. 肾区B超
C. 胸部CT
D. 肾动脉造影
E. 头颅X线平片

正确答案：A。鞍区MRI

解析：中年女性患者，向心性肥胖伴乏力，满月脸、多血质，皮肤可见宽大紫纹（库欣综合征典型临床表现）。尿皮质醇增高、小剂量地塞米松试验不能抑制（小剂量地塞米松试验为肥胖和库欣综合征的鉴别实验，阴性提示为库欣综合征），但大剂量地塞米松试验能抑制（提示为ACTH增多导致的继发性糖皮质激素增多），最可能的诊断为库欣病。库欣病的发病机制为垂体ACTH自主性分泌增多，大量ACTH作用于肾上腺皮质束状带细胞，引起以糖皮质激素为主的皮质醇分泌增多，糖皮质激素可作用于全身各系统器官产生临床症状。库欣病多由垂体功能性肿瘤引起，因此最需要进行的检查是鞍区MRI（A对），观察是否有垂体腺瘤。肾区B超（B错）可以诊断肾脏占位性病变或者肾脏尿路感染。胸部CT（C错）对于肺癌引起的异位ACTH综合征有诊断价值。肾动脉造影（D错）主要用于原发性醛固酮增多症或肾肿瘤的诊断。头颅X线平片（E错）对于垂体瘤的诊断价值有限。